下列药物使用方式，正确的是
A. 酵母片在餐后整片用水送服
B. 硝酸甘油片在心绞痛发作的紧急情况下嚼碎用水送服
C. 氧氟沙星滴眼液打开使用后，继续使用3个月
D. 乙酰半胱氨酸泡腾片用100ml温开水浸泡溶解后服用
E. 红霉素软膏涂敷于眼睑内，每晚睡前1次

正确答案：D。乙酰半胱氨酸泡腾片用100ml温开水浸泡溶解后服用

解析：本题考查各种剂型的正确使用。药物的使用中正确的是：乙酰半胱氨酸泡腾片用100ml温开水浸泡溶解后服用（D对）。助消化药酵母片宜嚼碎后服用，有利于药物吸收（A错）。硝酸甘油片应在舌下含服，由舌下静脉吸收（B错）。滴眼剂连续应用1个月不应再用（C错）。红霉素软膏不可用于眼睛（E错）。